在固体石蜡的粉碎过程中加入干冰的方法属于
A. 闭塞粉碎
B. 开路粉碎
C. 湿法粉碎
D. 低温粉碎
E. 混合粉碎

正确答案：D。低温粉碎